治疗小儿厌食脾胃阴虚证的用方是
A. 健脾丸
B. 异功散
C. 养胃增液汤
D. 木香大安丸
E. 香砂六君子汤

正确答案：C。养胃增液汤

解析：该题考查小儿厌食脾胃阴虚证的方药。小儿厌食脾胃阴虚证的证候不思进食，食少饮多，皮肤失润，大便偏干，小便短黄，甚或烦躁少寐，手足心热，舌红少津，苔少或花剥，脉细数。治法滋脾养胃，佐以助运，方药养胃增液汤加减（C对）。健脾丸治疗积滞脾虚夹积（A错）。异功散治疗厌食脾胃气虚（B错）。木香大安丸消食导滞，治疗小儿积食（D错）。香砂六君子汤益气健脾，行气化痰脾胃气虚，治疗痰阻气滞证（E错）。